软化印模膏的水温应在
A. 40～50℃
B. 50～60℃
C. 60～70℃
D. 30～40℃
E. 70～80℃

正确答案：C。60～70℃

解析：本题考查软化印模膏的水温。印模膏又称印模胶，是一种加热软化、冷却后硬固的非弹性可逆性印模材料，其热软冷硬间得变化是温度的改变只有达到合适的温度60～70℃（C对），才能有较好的可塑性，属热塑性材料，易于操作并可反复使用。水温高于60～70℃达70～80℃（E错），会使印模膏过软，受压时变形率过大，取得的阴模不准确。水温低于60～70℃时如温度为40～50℃（A错）、50～60℃（B错）印模膏的硬度较大，可塑性差，无法取得准确的阴模。印模膏在60～70℃的温水中软化后可用于全口义齿制作时个别托盘的边缘整塑和混合性可摘局部义齿制作时功能性印模的制取。